区分胃幽门与十二指肠的解剖标志是
A. 胃冠状静脉
B. 胃短静脉
C. 胃网膜右动脉
D. 幽门前静脉
E. 胃十二指肠动脉

正确答案：D。幽门前静脉

解析：区分胃幽门与十二指肠的解剖标志是幽门前静脉（D对）（P337），其走行于幽门部环形肌增厚形成的浅沟内。